桑寄生的功效是
A. 利水
B. 安胎
C. 通络
D. 补肝肾
E. 强筋骨

正确答案：B、D、E。安胎；补肝肾；强筋骨

解析：本题考查的是桑寄生的功效。桑寄生的功效是安胎（B对）、补肝肾（D对）与强筋骨（E对）。桑寄生：【功效】祛风湿，补肝肾，强筋骨，安胎。桑枝：【功效】祛风通络（C错），利水（A错）。